乙型强心苷苷元甾体母核中C-17位上的取代基是
A. 醛基
B. 六元不饱和内酯环
C. 糖链
D. 羧基
E. 五元不饱和内酯环

正确答案：B。六元不饱和内酯环

解析：本题考查的是强心苷的分类。乙型强心苷苷元甾体母核中C-17位上的取代基是六元不饱和内酯环（B对）。强心苷的分类：根据C-17侧链不饱和内酯环的不同，将强心苷元分为两类。①甲型强心苷元（强心甾烯类）：甾体母核的C-17侧链为五元不饱和内酯环（E错），基本母核称为强心甾，由23个碳原子构成。在已知的强心苷元中，大多属于此类。②乙型强心苷元（海葱甾二烯或蟾蜍甾二烯类）：甾体母核的C-17侧链为六元不饱和内酯环，基本母核为海葱甾或蟾蜍甾。自然界中仅少数苷元属此类，如中药蟾蜍中的强心成分蟾毒配基类。强心苷分子中可能存在醛基（A错）、糖链（C错）、羧基（D错）等。